关于问诊，不正确的是
A. 最好直接询问患者
B. 不应暗示患者
C. 严格使用医学术语
D. 问诊过程中，要不断思考
E. 有关病情介绍只能做参考

正确答案：C。严格使用医学术语

解析：问诊是医师通过对患者或相关人员的系统询问获取病史资料，经过综合分析而作出临床判断的一种诊法，其要求有：①最好直接询问患者（A对）；②不应暗示患者（B对）；③避免医学术语（C错，为本题正确答案）；④问诊过程中，要不断思考（D对）；⑤有关病情介绍只能做参考（E对）。